下列关于溶血性黄疸的叙述正确的
A. 直接迅速反应阳性
B. 尿综合胆红素阴性
C. 血中非结合胆红素不增加
D. 尿胆原阴性
E. 大便呈灰白色

正确答案：B。尿综合胆红素阴性

解析：一般能引起溶血的疾病都能引发溶血性黄疸，溶血性黄疸常表现为血中非结合胆红素增加（C错），结合胆红素一般正常，故直接迅速反应阴性（A错）。因为未结合胆红素不溶于水，结合胆红素又可正常排泄，故尿综合胆红素阴性（B对）。由于结合胆红素排入肠道增多，所以尿胆原增多，呈阳性反应（D错）。同时粪胆原增多，大便颜色加深（E错）。